关于正中联合部双发骨折，描述不正确的是
A. 如为粉碎性骨折或有骨质缺损，下颌牙弓变窄
B. 骨折线两侧肌群牵引力量相等，常无明显移位
C. 正中骨折段可因降颌肌群的作用而向下后方移位
D. 两侧骨折段受下颌舌骨肌的牵引可向中线移位
E. 如为粉碎性骨折或有骨质缺损，可致舌后坠甚至窒息

正确答案：B。骨折线两侧肌群牵引力量相等，常无明显移位

解析：本题考查正中联合部骨折。关于正中联合部双发骨折，描述不正确的是骨折线两侧肌群牵引力量相等，常无明显移位（B错，为本题的正确答案）。正中联合部骨折：（1）单发的正中联合部骨折，由于骨折线两侧肌群牵拉力相等，常无明显移位；有时仅可见骨折线两侧的牙高低不一致。（2）如为正中联合部两侧双发骨折，正中骨折段可因降颌肌群的作用而向后下方移位（C对）。（3）如发生粉碎性骨折或有骨质缺损，两侧骨折段受下颌舌骨肌的牵拉可向中线移位（D对），使下颌牙弓变窄（A对），受颏舌骨肌和颏舌肌的牵拉，中间骨折端发生向后移位。后两种骨折均可使舌后坠，可引起呼吸困难，甚至窒息的危险（E对）。